黄疸患者，身目俱黄，黄色鲜明，恶心欲吐，发热恶寒，无汗身痛，小便短赤，舌苔薄黄腻，脉弦滑。治疗应首选
A. 大柴胡汤
B. 小柴胡汤
C. 麻黄连翘赤小豆汤
D. 茵陈蒿汤
E. 犀角散

正确答案：C。麻黄连翘赤小豆汤

解析：题中为黄疸患者，湿热蕴阻中焦，熏蒸肝胆，致胆汁外溢，故身目俱黄；热为阳邪，故黄色鲜明；肝热犯胃，故恶心欲吐；热灼津液，阳明燥结，故小便短赤；发热恶寒，无汗身痛为外感表证之象；舌苔薄黄腻，脉弦滑为湿热之象，但题中患者湿热无明显偏向，且外感表证，邪郁肌表，故治宜疏表清热，利湿退黄。大柴胡汤功能疏肝利胆，通腑泄热，为黄疸胆腑郁热证的选方（A错）。小柴胡汤功能和解少阳，可治疗黄疸见少阳证者（B错）。黄疸阳黄邪郁肌表者，治宜疏表清热，利湿退黄，首选麻黄连翘赤小豆汤（C对）。茵陈蒿汤功能清热通腑，利湿退黄，为阳黄热重于湿证的选方（D错）。犀角散功能清热退黄，凉营解毒，为黄疸疫毒炽盛证的选方（E错）。